药品上市许可持有人或者代理人给予使用其药品的医疗机构的负责人、药品采购人员、医师、药师等有关人员财物或者其他不正当利益的，对其作出没收违法所得，并处30万元以上300万元以下罚款的部门是
A. 卫生健康主管部门
B. 医疗保障主管部门
C. 商务部门
D. 市场监督管理部门

正确答案：D。市场监督管理部门

解析：本题考查药品商业贿赂行为的法律责任。根据《药品管理法》第一百四十一条规定，药品上市许可持有人、药品生产企业、药品经营企业或者医疗机构在药品购销中给予、收受回扣或者其他不正当利益的，药品上市许可持有人、药品生产企业、药品经营企业或者代理人给予使用其药品的医疗机构的负责人、药品采购人员、医师、药师等有关人员财物或者其他不正当利益的，由市场监督管理部门（D对）没收违法所得，并处三十万元以上三百万元以下的罚款。《药品管理法》第一百四十二条第二款规定了对医疗机构的负责人、药品采购人员、医师、药师等人员的处罚。该条款规定：医疗机构的负责人、药品采购人员、医师、药师等有关人员收受药品上市许可持有人、药品生产企业、药品经营企业或者代理人给予的财物或者其他不正当利益的，由卫生健康主管部门（A错）或者本单位给予处分，没收违法所得；情节严重的，还应当吊销其执业证书。医疗保障主管部门（B错）管理价格的药品范围，包括化学药品、中成药、生化药品、中药饮片、医疗机构制剂等。商务部门（C错）负责拟订药品流通发展规划和政策，药品监督管理部门在药品监督管理工作中，配合执行药品流通发展规划和政策。商务部发放药品类易制毒化学品进口许可前，应当征得国家药品监督管理局同意。